男性，38岁，胃大部切除、毕Ⅱ式吻合术后20天，进食后30分钟上腹突然胀痛，喷射性呕吐大量不含食物的胆汁，吐后腹痛消失，最可能的原因是
A. 吻合口梗阻
B. 急性完全性输入段梗阻
C. 慢性不完全性输入段梗阻
D. 输出段梗阻
E. 倾倒综合征

正确答案：C。慢性不完全性输入段梗阻

解析：青年男性患者，毕Ⅱ式胃大部切除术后20天，进食后半小时突发上腹胀痛，呕吐大量不含食物的胆汁（提示输入段梗阻），呕吐后腹痛消失，该患者最可能的诊断为慢性不完全性输入段梗阻（C对）。毕Ⅱ式胃大部切除术是指在切除远端胃后，缝闭十二指肠断端，残胃和上段空肠作端侧吻合。以吻合口为标志，吻合口近端的空肠为输入段，吻合口远端的空肠为输出段。胆总管开口于十二指肠降部大乳头，因此术后，胆汁可依次经过十二指肠大乳头、输入段、吻合口、胃或输出段。慢性不完全性输入段梗阻产生的原因是输入段过长扭曲，或输入段受牵拉在吻合口处呈锐角影响到肠道排空。由于消化液积聚在输入段内，进食后消化液分泌增加，输入段内压力突增并刺激肠管剧烈收缩，引发喷射样呕吐，呕吐量大，呕吐物为胆汁、不含食物。吻合口梗阻（A错）多由于吻合口过小或吻合时内翻过多，加上术后吻合口水肿所致，呕吐物主要是食物，不含胆汁。急性完全性输入段梗阻（B错）由于胆汁不能进入胃内，故呕吐物量少，不含胆汁。输出襻梗阻（D错）临床表现为上腹部饱胀，呕吐物含胆汁的胃内容物。倾倒综合征（E错）指胃大部切除术后，由于失去了幽门的节制功能，导致胃排空过快而产生的一系列临床症状，可分为早期和晚期两种类型，早期主要表现为心悸、出冷汗、乏力、面色苍白等，晚期还可出现头晕、脉搏细数等表现。